药物组成中含有柴胡和人参的方剂是
A. 小柴胡汤
B. 半夏泻心汤
C. 大柴胡汤
D. 四逆散
E. 柴胡疏肝散

正确答案：A。小柴胡汤

解析：本题考查方剂组成，记忆即可。小柴胡汤由柴胡 、黄芩 、人参 、炙甘草、 半夏 、生姜、 大枣组成（A对）。半夏泻心汤由半夏、 黄芩、干姜、人参、黄连、 大枣 、炙甘草组成（B错）。方歌：半夏泻心配芩连，干姜人参草枣全；辛开苦降除痞满，寒热错杂痞证蠲。大柴胡汤由柴胡、黄芩、大黄、枳实、半夏、白芍、大枣、生姜组成（C错）。方歌：大柴胡汤用大黄，枳芩夏芍枣生姜，少阳阳明同合病，和解攻里效无双。四逆散由柴胡、芍药、枳实、甘草组成（D错），方歌：阳郁厥逆四逆散，等分柴芍枳实甘，透邪解郁理肝脾，肝郁脾滞力能堪。柴胡疏肝散由陈皮、柴胡、川芎、香附、枳壳、芍药、甘草组成（E错）。